关于脑脊液描述，哪项是错误的
A. 部分产生于侧脑室脉络丛
B. 充填于脑室内
C. 第四脑室的脑脊液经正中孔和两个外侧孔流入蛛网膜下隙
D. 经蛛网粒渗入上矢状窦内
E. 脑脊液中含有大量的红细胞。

正确答案：E。脑脊液中含有大量的红细胞。

解析：脑脊液是充填于脑室内（B对）、蛛网膜下隙和脊髓中央管的无色透明液体，正常时不含红细胞（E错，为本题正确答案）。脑脊液产生于各个脑室脉络丛（A对），侧脑室脉络丛产生的脑脊液经室间孔流至第三脑室，与第三脑室脉络丛产生的脑脊液一起，经中脑水管流入第四脑室，再汇合第四脑室脉络丛产生的脑脊液一起经第四脑室正中孔和两个外侧孔流入脑和脊髓周围的蛛网膜下隙（C对），然后脑脊液再沿此隙流向大脑背面的蛛网膜下隙，经蛛网膜粒渗透入硬脑膜窦内（主要是上矢状窦）（D对），回流入血液中。